治疗肺癌肺脾气虚证，应首选
A. 导痰汤
B. 温胆汤
C. 六君子汤
D. 七味白术散
E. 补中益气汤

正确答案：C。六君子汤

解析：肺癌肺脾气虚证治宜补益肺脾，化痰，首选益气健脾，燥湿化痰的六君子汤（C对）。导痰汤功用燥湿豁痰，行气开郁，适用于治疗肺癌痰湿毒蕴证（A错）。温胆汤理气化痰，和胃利胆，主治胆郁痰扰证（B错）。七味白术散功用健脾益气，和胃生津，适用于脾胃虚弱，津虚内热证（D错）。补中益气汤功用补中益气，升阳举陷主治脾胃气虚证、气虚下陷证、气虚发热证（E错）。